我国卫生法律是由哪一级机构制定和颁布的
A. 卫生部
B. 国务院
C. 最高人民法院
D. 全国人大及其常委会
E. 地方人民政府

正确答案：D。全国人大及其常委会

解析：全国人大及其常委会是宪法和基本法律的制定和颁布机构，卫生法属于基本法律，故我国卫生法律是由全国人大及其常委会制定的（D对）。卫生部制定卫生部门规章（A错）。国务院制定卫生行政法规（B错）。最高人民法院为我国最高审判机关，无立法权（C错）。地方人民政府制定地方政府卫生规章（E错）。